男，45岁，右眼睑下垂伴复视2月，既往有蛛网膜下腔出血病史，查体，右眼外斜，瞳孔变大，对光反射阴性，增强CT提示，鞍区有一直径0.5cm圆形高密度影，无脑水肿表现
A. 鞍旁脑膜瘤
B. 鞍叶脑脓肿
C. 颈内动脉-后交通动脉瘤
D. 鞍叶胶质瘤
E. 三叉神经鞘瘤

正确答案：C。颈内动脉-后交通动脉瘤

解析：患者男，45岁，右眼睑下垂伴复视2月，既往有蛛网膜下腔出血病史，查体，右眼外斜，瞳孔变大，对光反射阴性，增强ct提示，鞍区有一直径0.5cm圆形高密度影（颈内动脉-后交通动脉瘤出现动眼神经受压的表现），无脑水肿表现，结合患者的表现和辅助检查，提示为颈内动脉-后交通动脉瘤（C对）。（P129）肿瘤的特异发病部位，如垂体瘤位于鞍内，听经瘤位于脑桥小脑脚，脑膜瘤位于硬脑膜附近等（A错）。